治疗中风闭证，除选太冲、劳宫外还应选穴是
A. 水分
B. 水沟
C. 下关
D. 中冲
E. 委中

正确答案：B。水沟

解析：本题考查常见的病症的辩证、处方。中风中脏腑宜醒神开窍、启闭固脱，以手厥阴经及督脉穴为主，主穴用内关、水沟。闭证加十二井穴、太冲、合谷，脱证加关元、气海、神阙。内关调心神，水沟醒神开窍。对中风选穴理解记忆后可做出选择（B对）。